酸性汗味最常见于
A. 风湿热或长期服用解热镇痛药物的患者
B. 脚癣合并感染者
C. 腋臭患者
D. 多汗者
E. 正常人的汗液

正确答案：A。风湿热或长期服用解热镇痛药物的患者

解析：正常汗液（E错）无特殊强烈刺激气味。酸性汗液见于风湿热和长期服用水杨酸、阿司匹林等解热镇痛药物的患者（A对）；特殊的狐臭味（C错）见于腺臭等患者。脚臭味见于多汗者（D错）或脚癣合并感染者（B错）。